对高血压合并糖尿病伴有微量蛋白尿的患者，首选的降压药是
A. β-受体阻断剂
B. α-受体阻断剂
C. 血管紧张素转换酶抑制剂
D. 噻嗪类利尿剂
E. 钙通道阻滞剂

正确答案：C。血管紧张素转换酶抑制剂

解析：本题考查降压药。对高血压合并糖尿病伴有微量蛋白尿的患者，首选的降压药是血管紧张素转换酶抑制剂（C对）。ACEI尤其适用于伴慢性心力衰竭、心肌梗死后心功能不全、心房颤动、糖尿病肾病、慢性肾脏病、代谢综合征、蛋白尿或微量白蛋白尿的患者。β-受体阻断剂（A错）适用于交感神经活性增高以及高动力状态的高血压患者，如伴有快速型心律失常、冠心病、慢性心力衰竭的患者。α-受体阻断剂（B错）适用于高血压伴前列腺增生症患者。噻嗪类利尿剂（D错）适用于老年高血压、单纯收缩期高血压或伴心力衰竭患者，也是难治性高血压的基础控压药物之一。钙通道阻滞剂（E错）尤其适用于老年高血压，单纯收缩期高血压，伴稳定型心绞痛、冠状动脉或颈动脉粥样硬化及周围血管疾病患者。